下列哪项不是肝损伤严重程度的指标
A. ALT
B. 胆红素
C. 白蛋白
D. AST
E. 凝血酶原活动度

正确答案：A。ALT

解析：胆红素、白蛋白、AST、凝血酶原活动度可用于衡量肝损伤严重程度。当肝严重损伤时，胆红素（B对）指标可出现异常，表现为血中结合胆红素和非结合胆红素增多。肝脏是白蛋白（C对）合成的主要场所，肝严重损伤时白蛋白可降低。AST（D对）主要主要存在于肝细胞线粒体中，正常时血清含量很低，当血清AST含量明显升高时提示肝严重损伤。肝脏是凝血因子合成的场所，肝严重损伤时凝血因子合成减少，凝血酶原活动度（E对）降低。ALT（A错，为本题正确答案）主要存在于肝细胞胞浆中，特异性不高。各种疾病导致肝细胞膜通透性增加时，血中ALT均可升高，故对衡量肝损伤严重程度的作用较其他四项小。